患者，男，50岁。肩关节疼痛，痛有定处，抬举困难，夜间痛甚，劳累加剧，治疗应首选
A. 手太阳经穴
B. 近部取穴为主
C. 近部取穴与远部取穴相结合
D. 循经取穴
E. 手少阳经穴

正确答案：C。近部取穴与远部取穴相结合

解析：本题考查常见的病症的辩证、处方。肩关节疼痛，痛有定处，抬举困难，夜间痛甚，劳累加剧，此患者所患之证为肩关节周围炎，其取穴原则应近部取穴与远部取穴相结合（C对B错）。手太阳经穴主要治疗肩后部疼痛（A错）。循经取穴是临床通常根据经脉循行和主治特点进行的，如《四总穴歌》所载“肚腹三里留，腰背委中求，头项寻列缺，面口合谷收”就是循经取穴的具体体现（D错）。手少阳经穴主要治疗上肢内后廉痛（E错）。